泽泻具有的功效是
A. 泄热
B. 清肝
C. 健脾
D. 清肺
E. 解暑

正确答案：A。泄热

解析：该题考查的是泽泻的功效，属记忆内容。泽泻功效利水渗湿，泄热(A对)。